使用BMI指数评价儿童的营养状况，18岁时肥胖该指数的评价标准是
A. BMI大于20
B. BMI大于24
C. BMI大于25
D. BMI大于28
E. BMI大于30

正确答案：D。BMI大于28